炮制法半夏应选的辅料是
A. 甘草、石灰
B. 生姜、明矾
C. 甘草、皂角
D. 甘草、银花
E. 甘草、明矾

正确答案：A。甘草、石灰